关于样本的叙述，下列哪项是正确的
A. 调查时样本含量越大越好
B. 使用更少的样本以便节省人力和物力
C. 调查时根据人力和物力来确定样本量
D. 调查时应用适合的样本量
E. 根据研究者的意愿来确定样本量

正确答案：D。调查时应用适合的样本量

解析：本题考查样本量的影响因素。样本量受到多种因素影响，如一般人群疾病发病率、显著性水平、效力等。在确定样本量时，不是由研究者意愿决定的（E错），应根据所研究的目的及研究方法，考虑影响样本量的因素的作用，从而选取合适的样本量进行计算（D对）。样本量过大（A错）会带来工作的复杂化，导致工作精细度下降。样本量过小（B错）会导致样本代表总体的能力不足。调查时应先确定样本量，在根据样本量的大小确定人力和物力的分配（C错）。